麻黄具有的功效是
A. 解鱼蟹毒
B. 平喘利水
C. 祛风胜湿
D. 行气宽中
E. 温经通阳

正确答案：B。平喘利水

解析：该题考查麻黄的功效。麻黄味辛、微苦，温。归肺、膀胱经。具有发汗解表，宣肺平喘，利水消肿的功效（B对ACDE错）。